女，38岁。上腹不适，纳差3年体重减轻，乏力半年，查体：贫血貌，上腹部轻压痛，Hb88g/L，MCV115fl，胃镜检查示胃体皱襞稀疏，黏膜血管透见。该患者发生贫血最可能的机制是
A. 维生素缺乏
B. 慢性消化道失血
C. 铁吸收障碍
D. 蛋白质吸收障碍
E. 内因子缺乏

正确答案：E。内因子缺乏

解析：该患者贫血貌，Hb88g/L（＜90g/L为中度贫血），发生贫血最可能的机制是内因子缺乏（E对）：患者为A型胃炎（自身免疫性胃炎），多累及壁细胞，导致内因子分泌减少，VitB₁₂吸收障碍，发生巨幼细胞性贫血，患者MCV115fl（＞100为大细胞性贫血），符合巨幼细胞性贫血诊断。维生素缺乏（A错）导致坏血病。慢性消化道失血（B错）、铁吸收障碍（C错）可导致缺铁性贫血。蛋白质吸收障碍（D错）导致营养不良。